增强靶组织对胰岛素敏感性的药物是
A. 二甲双胍
B. 阿卡波糖
C. 格列齐特
D. 曲格列酮
E. 格列喹酮

正确答案：D。曲格列酮

解析：曲格列酮属于噻唑烷二酮类，通过激活过氧化物酶体增殖 物激活受体起作用，增加靶组织对胰岛素作用的敏感性而降低血糖（D对）。双胍类是治疗Ⅱ型糖尿病的一线用药，目前广泛应用的是二甲双胍（A错），主要药理作用是通过抑制肝葡萄糖输出，改善外周组织对胰岛素敏感性，增加对葡萄糖的摄取和利用而降低血糖。阿卡波糖（B错）属于α葡萄糖苷酶抑制剂，主要通过抑制α-葡糖糖苷酶从而延迟碳水化合物吸收，降低餐后血糖；格列齐特（C错）、格列喹酮（E错）属于磺酰脲类药物，是促胰岛素分泌剂，主要作用为刺激胰岛β细胞分泌胰岛素，刺激含有胰岛素的颗粒外移和胰岛素释放，使血糖下降。